窝沟封闭固化后说法错误的是
A. 检查有无气泡存在
B. 封闭后应定期复诊
C. 脱落时无需重做封闭
D. 用探针进行全面检查
E. 咬合过高可适当调整咬合

正确答案：C。脱落时无需重做封闭

解析：封闭剂固化后，用探针进行全面检查，了解固化程度，黏结情况，有无气泡存在，寻找有无遗漏水封闭的窝沟，观察有无过多封闭材料是否需要去除，发现问题及时处理。如果封闭剂没有填料可不调咬合，如使用含有填料的封闭剂，又咬合过高，应调整咬合。封闭后还应在3个月、半年或一年复查，观察封闭剂保留情况，脱落时应重作封闭。掌握“窝沟封闭术”知识点。